帽状期牙胚中央，内釉上皮局部的增厚
A. 无釉柱釉质
B. 釉板
C. 釉索
D. 釉龛
E. 釉结

正确答案：E。釉结

解析：本题考查成釉器的发育-帽状期。帽状期牙胚中央，内釉上皮局部的增厚为釉结（E对），呈簇状的未分化上皮细胞。帽状期，釉质尚未形成，无法观察到无釉柱釉质和釉板（AB错）。釉索为一条在釉结处从内釉上皮延伸至外釉上皮的条索结构（C错）。在切片观察帽状期成釉器时，釉龛为充填于牙板凹凸不平的薄层结构中的结缔组织（D错）。